下列哪项不是自发性心绞痛的特点
A. 休息或夜间发作
B. 可持续15～30分钟
C. 含服硝酸甘油片不易缓解
D. 心电图出现异常Q波
E. 血清酶一般正常

正确答案：D。心电图出现异常Q波

解析：自发性心绞痛又叫变异型心绞痛。变异性心绞痛比较少见，常为自发性，诱因不明显，休息时发作，甚至在睡眠中痛醒。有的患者定期发作，多在24:00以后，一般在午夜或者凌晨（A对）。发作持续时间较长，可持续数分钟至半小时（B对），疼痛常剧烈难忍。这种患者常伴有心功能不全，有的发作时希望活动以减轻疼痛。变异型心绞痛的发作与心肌耗氧量的增加无关，且不易为硝酸甘油所缓解（C对）。且血清酶多正常（E对）。心电图出现异常Q波为陈旧性心肌梗死的表现，而自发性心绞痛患者相关导联ST段抬高，提示透壁性心肌缺血，为变异型心绞痛的特征（D错，为本题正确答案）。